不是涂料中常见的污染物质的是
A. 甲醛
B. POP
C. 苯类物质
D. 甲苯二异氰酸酯
E. 漆酚

正确答案：B。POP

解析：本题考查涂料中常见的污染物质。涂料指涂布于物体表面能形成坚韧的薄膜，具有保护、装溃或其他特殊作用（绝缘、防锈、防霉、抛光、耐热等）的物质。涂料中常见的污染物质有：甲醛（A对）；苯类物质（C对）；甲苯二异氰酸酯（D对）；漆酚（E对）。POP（B错，为本题正确答案）即持久性有机污染物，是指能持久存在于环境中，并可借助大气、水、生物体等环境介质进行远距离迁移，通过食物链富集，对环境和人类健康造成严重危害的天然或人工合成的有机污染物质 。